错误的是
A. 屈、伸是沿冠状轴进行的运动
B. 内收、外展是沿矢状轴进行的运动
C. 旋内、旋外是沿垂直轴进行的运动
D. 足的背屈又称屈
E. 无

正确答案：D。足的背屈又称屈

解析：在关节的运动中，屈、伸通常是指关节沿冠状轴进行的运动（A对）。收和展是关节沿矢状轴进行的运动（B对）。旋转是关节沿垂直轴进行的运动（C对）。足的背屈又叫做“伸”，屈的别名是跖屈（D错，为本题正确答案）。